母乳喂养应遵循的原则是
A. 按时
B. 按需
C. 按量
D. 按时按量
E. 按时不按量

正确答案：B。按需

解析：该题考查母乳喂养应遵循的原则，理解记忆。母乳喂养的方法，应由乳母细心观察婴儿的个体需要，以按需喂养为原则（B对）。